属于肠溶包衣材料的是
A. Ⅱ号、Ⅲ号丙烯酸树脂
B. 羟丙甲纤维素
C. 硅橡胶
D. 离子交换树脂
E. 鞣酸

正确答案：A。Ⅱ号、Ⅲ号丙烯酸树脂

解析：本题考查片剂的包衣。Ⅱ号、Ⅲ号丙烯酸树脂（A对）属于肠溶包衣材料；羟丙甲纤维素（B错）为胃溶型薄膜包衣材料；硅橡胶（C错）为医学领域常用材料；离子交换树脂（D错）是带有离子交换基团的不溶性高分子化合物；鞣酸（E错）系由五倍子中得到的一种鞣质，用途广泛。